可摘局部义齿修复时，调磨基牙的原因是
A. 基牙牙冠大
B. 基牙（牙合）面磨耗
C. 基牙倾斜
D. 增加倒凹
E. 放置支托

正确答案：C。基牙倾斜

解析：本题考查调磨基牙的原因。若戴入义齿时因基牙倾斜（C对）阻碍卡环，而使卡环无法完全就位，则可以调磨少许基牙。基牙牙冠大（A错），应该根据基牙外形制作相应的卡环，不应该以调磨基牙来适应卡环，以免去除过多健康牙体组织。基牙（牙合）面磨耗（B错）是因为对颌牙尖过锐、经常吃过硬的食物或夜磨牙，应该调磨对（牙合）牙或者改变饮食习惯。倒凹过大卡环体就位困难并且易使卡环超过其弹性形变而变形，故不宜增加倒凹（D错）。支托（E错）是可摘局部义齿的重要部件，呈圆三角形或者匙形，是专门用桃形车针预备出来的，不属于调磨基牙的范畴。